器械消毒时要进行封包，下列关于封包叙述错误的是
A. 包外应设有灭菌化学指示物，并标有灭菌器编号、灭菌批次、灭菌日期及失效期
B. 口腔门诊手术包内应放置包内指示物
C. 可使用封闭式的金属盒装载器械灭菌
D. 纸塑袋、纸袋等密封包装其密封宽度≥6mm，包内器械距包装袋封口处≥2.5cm
E. 医用塑封机在每日使用前检查参数的准确性和封闭完好性

正确答案：C。可使用封闭式的金属盒装载器械灭菌

解析：封包注意事项：①包外应设有灭菌化学指示物，并标有灭菌器编号、灭菌批次、灭菌日期及失效期；②口腔门诊手术包内应放置包内指示物；③纸塑袋、纸袋等密封包装其密封宽度≥6mm，包内器械距包装袋封口处≥2.5cm；④医用塑封机在每日使用前检查参数的准确性和封闭完好性。不可使用封闭式的金属盒装载器械灭菌，这样会引起消毒灭菌不全甚至失败。掌握“口腔器械的消毒与灭菌及医疗废物处理”知识点。